根面化学处理，最常见使用的药物是
A. 37％磷酸
B. 10％枸橼酸
C. 20％磷酸
D. 10％醋酸
E. 10％盐酸

正确答案：B。10％枸橼酸

解析：本题考查根面化学处理最常使用的药物。枸橼酸为临床上常用的有机酸，无味，不会引起机体反应和不适,在临床应用中，一般使用10％枸橼酸，10％枸橼酸（B对）能够有效去除根面玷污层，为良好的根面化学处理剂。磷酸，醋酸和盐酸酸性较强，会对牙根面造成过酸蚀和破坏，37％磷酸（A错）常用于牙体酸蚀剂。20％磷酸（C错）不是口腔疾病用药的浓度。10％醋酸（D错）常用于浸泡治疗手足癣，不常用于口腔疾病。盐酸（E错）为强酸，会损伤黏膜，在口腔疾病中不使用盐酸。